下列哪种酶缺乏引起蚕豆病
A. 葡萄糖－6－磷酸脱氢酶
B. 苯丙氨酸羟化酶
C. 丙酮酸脱氢酶
D. 磷酸果糖激酶－1
E. 己糖激酶

正确答案：A。葡萄糖－6－磷酸脱氢酶

解析：葡萄糖－6－磷酸脱氢酶缺乏会引起蚕豆病（A对）。葡萄糖－6－磷酸脱氢酶是人体内磷酸戊糖途径的关键酶，其缺乏会导致患者不能通过磷酸戊糖途径提供足够的NADPH，难以使谷胱甘肽保持还原状态，因而表现出红细胞（尤其是较老的红细胞）易于破裂，发生溶血性黄疸。这种溶血现象常在食用蚕豆（是强氧化剂）后出现，故称为蚕豆病。苯丙氨酸羟化酶（B错）是一种由苯丙氨酸形成的酪氨酸加氧酶，缺乏此酶会引起苯丙酮酸尿症。丙酮酸脱氢酶（C错）催化丙酮酸不可逆的氧化脱羧转化成乙酰辅酶A，将糖的有氧氧化与三羧酸循环和氧化磷酸化连接起来， 在细胞线粒体呼吸链能量代谢中的作用至关重要。磷酸果糖激酶－1（D错）在糖的无氧氧化中作用于果糖-6-磷酸使其不可逆得转变为果糖1，6-二磷酸。己糖激酶（E错）是一种转移酶，专一性不强，可以针对多种六碳糖进行作用。